Cox回归的因变量是
A. 生存时间
B. 结局变量
C. 生存时间和结局变量
D. 完全数据
E. 正态和方差齐性

正确答案：C。生存时间和结局变量

解析：本题考查cox回归。Cox回归的因变量是生存时间和结局变量（C对ABDE错）。